检查颞肌、咬肌的收缩力，触痛，观察其两侧是否对称、协调。属于以上哪项
A. 外形与关节动度检查
B. 咀嚼肌检查
C. 颈前三角检查
D. （牙合）关系检查
E. 下颌运动检查

正确答案：B。咀嚼肌检查

解析：咀嚼肌检查：检查颞肌、咬肌等咀嚼肌群的收缩力，触压其有否疼痛，观察其两侧是否对称、协调。在口内可按咀嚼肌的解剖部位，扪触颞肌前份（下颌升支前缘向上）、翼外肌下头（上颌结节后上方）和翼内肌下部（下颌磨牙舌侧的后下方及下颌支的内侧面），进行左右比较，检查有否压痛等异常。掌握“口外一般检查及辅助检查”知识点。